女，26岁。妊娠33周，妊娠期糖尿病，通过调整饮食血糖水平控制良好、胎儿大小发育正常。下一步的处理是
A. 给于地塞米松
B. 每日监测血糖
C. 加用胰岛素治疗
D. 口服二甲双胍
E. 继续控制饮食

正确答案：E。继续控制饮食

解析：患者孕33周，胎儿大小发育正常。通过调整饮食血糖水平控制良好，下一步应继续控制饮食（E对），定期监测血糖。妊娠期糖尿病孕妇在饮食控制血糖不达标时应用胰岛素治疗（C错），口服降糖药物二甲双胍（D错）、格列本脲等应用于孕妇的安全性和有效性尚未得到证实，仅对于胰岛素用量较大或拒绝使用胰岛素的孕妇，且知情同意下谨慎使用。妊娠期糖尿病应尽量在38周后分娩，但若出现血糖控制不满意、伴血管病变、合并重度子痫前期、严重感染、胎儿宫内生长受限、胎儿窘迫等时，需提前终止妊娠，若胎肺尚未成熟需应用地塞米松促胎肺成熟者，可行羊膜腔穿刺，了解胎肺成熟情况并同时注入地塞米松（A错）。